用10%的氯化钠注射液和注射用水配制3%的氯化钠注射液100ml，所需的10%氯化钠注射液的毫升数是
A. 25
B. 30
C. 10
D. 33.3
E. 20

正确答案：B。30

解析：本题考查稀释计算。稀释前后溶质氯化钠的量不变，故所需的10%氯化钠体积=3%×100/10%=30ml（B对）。